能清热解毒，善治病毒性感冒的药是
A. 风热感冒颗粒
B. 小柴胡颗粒
C. 治感佳胶囊
D. 板蓝根片
E. 柴胡口服液

正确答案：D。板蓝根片